牙周-牙髓联合病变治疗的原则是
A. 尽量查清病源，确定治疗的主次
B. 一般来说，死髓牙先作牙髓治疗，配合一般牙周治疗
C. 逆行性牙髓炎，如牙周病变十分严重，不易彻底控制炎症，可直接拔除
D. 对牙周袋深而牙髓活力迟钝的牙，不宜过于保守，应同时作牙髓治疗，以利于牙周病变的愈合
E. 以上都对

正确答案：E。以上都对

解析：本题考查牙周-牙髓联合病变的治疗原则。总的来说，有牙周一牙髓联合病变时，应尽量查清病源，确定治疗的主次（A对）。在不能确定的情况下，一般来说，死髓牙先作牙髓治疗，配合一般牙周治疗（B对）；活髓牙则先做系统的牙周治疗和调牙合，若疗效不佳，再视情况行牙髓治疗。逆行性牙髓炎的患牙能否保留，主要取决于该牙的牙周病变程度和牙周治疗效果，如牙周袋能消除或变浅，病变能控制，则可先做牙髓治疗，同时开始牙周炎的治疗；如牙周病变十分严重，不易彻底控制炎症，可直接拔除（C对）。对于就诊时已有深牙周袋者，若牙髓活力尚好，则可先行牙周治疗，若效果不佳者应采用多种手段检测牙髓活力，决定是否进行牙髓治疗。对牙周袋深而牙髓活力迟钝的牙，不宜过于保守，应同时作牙髓治疗，以利于牙周病变的愈合（D对）。（ABCD均对，故E为本题的正确答案）。